以下哪一项不属于四环素的不良反应
A. 骨髓抑制
B. 二重感染
C. 呕吐、腹泻
D. 影响骨和牙齿的生长
E. 加重原有的肾损伤

正确答案：A。骨髓抑制

解析：四环素类不良反应可有：①局部刺激作用：口服可引起恶心、呕吐、腹泻等症状。静脉滴注易引起静脉炎；②二重感染；③对骨骼和牙齿生长的影响；④长期大剂量使用可引起严重肝损伤或加重原有的肾损伤。偶见过敏反应。掌握“四环素、多西环素及米诺环素”知识点。